男性，30岁，因反复出现癫痫大发作半年余，近一月来智力有所下降，经CT检查诊断为脑囊虫病。应首先考虑的临床类型是
A. 脑实质型
B. 脑室型
C. 软脑膜型
D. 脊髓型
E. 混合型

正确答案：A。脑实质型

解析：脑囊虫病是由猪绦虫蚴虫（囊尾蚴）寄生脑组织形成包囊所致。若包囊位置位于脑实质（A对）的皮质部分，可出现反复的癫痫大发作，随着包囊数目的增多并侵犯到额叶或颞叶等部位则可出现智力下降表现。脑室型（B错）可导致阻塞性脑积水，导致颅内压急剧升高，表现为眩晕、呕吐、意识障碍和跌倒，甚至死亡等。软脑膜型（C错）表现为脑膜刺激征。脊髓型（D错）非常罕见，无癫痫及智力下降症状。混合型（E错）表现为以上四型的综合症状。